发现早期肺结核的主要方法是
A. 胸部高分辨CT
B. 痰涂片抗酸染色
C. 胸部X线检查
D. 血清特异性抗体检查
E. 血沉检查

正确答案：C。胸部X线检查

解析：胸部X线是发现早期肺结核的主要方法，可以发现早期轻微的结核病变（C对），同时也是诊断肺结核的常规首选方法。胸部高分辨CT（A错）有助于诊断，但价格较X线昂贵，不是主要的方法。痰涂片抗酸染色（B错）是简单、快速、易行和可靠的方法，但欠敏感，如样本中结核分枝杆菌含量少，直接涂片不易检出。肺结核的诊断分为细菌学诊断和临床诊断，前者为生物标本经涂片镜检、培养或世卫组织批准的快速诊断试剂检验为阳性者，并具有相应临床和X线表现，不论其是否已开始结核病治疗，均按确诊肺结核报告；后者为不符合细菌学确诊标准，但根据影像学、组织学等其他临床结果考虑为活动性肺结核病并决定给予全疗程结核病治疗的病例。用免疫学方法检测血清特异性抗体（D错），结核分枝杆菌感染后产生多种抗体。ELISA 检测病人血清中特异性抗体，目前已有几种试剂盒在临床使用，但仍需进一步提高其敏感性和特异性。血沉检查（E错）是检查炎症感染的指标，没有特异性。